下列哪种激素不是由腺垂体合成、分泌的
A. 促甲状腺激素
B. 生长素
C. 缩宫素
D. 促肾上腺皮质激素
E. 黄体生成素

正确答案：C。缩宫素